用记账法进行膳食调查，不需要的数据是
A. 各餐用膳人数
B. 调查开始时库存各类食物的数量
C. 称量烹调前后各种食物的生重和熟重
D. 每日各种食物购入量
E. 调查结束时剩余食物数量

正确答案：C。称量烹调前后各种食物的生重和熟重